医师中止执业活动的情形消失后，需要恢复执业活动的，应当经所在地的县级以上卫生行政部门委托的机构或者组织考核合格，并依法申请办理
A. 准予注册手续
B. 中止注册手续
C. 注销注册手续
D. 变更注册手续
E. 重新注册手续

正确答案：E。重新注册手续